有关左旋多巴药理作用叙述错误的是
A. 奏效较慢，用药2～3周后才出现体征的改善
B. 对轻症及年轻患者疗效较好
C. 对肌震颤的疗效较好
D. 可促进催乳素抑制因子的释放
E. 对肌肉僵直及少动的疗效较好

正确答案：C。对肌震颤的疗效较好